推广使用安全套的措施。最适合的人群是
A. 大、中学生
B. 社区居民
C. 卖淫嫖娼者
D. 老年人
E. 以上都正确

正确答案：C。卖淫嫖娼者